常与去间羟胺合用作心室内注射治疗心脏骤停的药物是
A. 去甲肾上腺素
B. 肾上腺素
C. 多巴胺
D. 异丙肾上腺素
E. 乙酰胆碱

正确答案：D。异丙肾上腺素

解析：异丙肾上腺素常与去甲肾上腺素或间羟胺合用治疗高度房室传导阻滞或窦房结功能衰竭而并发的心脏骤停。掌握“多巴胺和异丙肾上腺素”知识点。